二母宁嗽丸的功效是
A. 清热化痰，降气平喘
B. 清肺止咳，化痰
C. 清热化痰，敛肺止咳
D. 清热化痰，宣肺止咳
E. 清肺润燥，化痰止咳

正确答案：E。清肺润燥，化痰止咳

解析：本题考查的是二母宁嗽丸的功能。二母宁嗽丸的功效是清肺润燥，化痰止咳（E对）。二母宁嗽丸：【功能】清肺润燥，化痰止咳。清肺抑火丸：【功能】清肺止咳，化痰（B错）通便。强力枇杷露：【功能】清热化痰，敛肺止咳（C错）。急支糖浆：【功能】清热化痰，宣肺止咳（D错）。功能为清热化痰，降气平喘（A错）的中成药，2022年考试指南未明确说明。